牙髓及牙周膜的痛觉感受器密度从高到低依次的部位为
A. 前牙、前磨牙、磨牙
B. 前牙、磨牙、前磨牙
C. 前磨牙、磨牙、前牙
D. 磨牙、前牙、前磨牙
E. 磨牙、前磨牙、前牙

正确答案：A。前牙、前磨牙、磨牙

解析：牙髓及牙周膜的痛觉感受器密度从高到低依次的部位为前牙、前磨牙、磨牙。掌握“口腔感觉”知识点。